在中枢神经系内，起止与功能相同的一束纤维称
A. 纤维束
B. 白质
C. 神经
D. 网状结构
E. 无

正确答案：A。纤维束

解析：在中枢神经系统内，起止、行程和功能相同的神经纤维集聚并走行在一起称纤维束（A对）；数个神经纤维束集中形成神经（C错）；白质（B错）由各种不同功能的神经纤维在中枢神经系统内聚集而成；网状结构（D错）指脑干内弥散的白质纤维交织成网、网眼内散布不同大小的神经元的细胞体与纤维混杂区。